下列关于“三同时”论述错误的是
A. 是对新建、扩建、改建企业项目进行的卫生监督要求
B. 是指职业卫生防护设施与主体工程同时设计、同时施工、同时投产
C. 是预防性卫生监督内容
D. 目的在于保证投产后劳动环境符合卫生标准要求
E. 具有法律效力

正确答案：E。具有法律效力